选用儿童心理测定量表的基本原则中不包括
A. 适合儿童年龄的公认的
B. 简便有效的
C. 方法引起小儿兴趣，而被接受
D. 量表经过标准化，信度好
E. 量表的效度好

正确答案：C。方法引起小儿兴趣，而被接受

解析：本题考查儿童心理测定量表的基本原则。测试结果的可靠性与测试过程的严谨态度密切相关，不能因为小儿兴趣而定（C错，为本题正确答案）。选用儿童心理测定量表的基本原则包括：适合儿童年龄的公认的（A对）、简便有效的（B对）量表经过标准化，信效度好（DE对）。